建立医患关系的原则是
A. 疾病性质和病人年龄
B. 疾病性质和病人的人格特征
C. 疾病病程和病人的经济状况
D. 病人的文化程度和情绪反应
E. 病人的社会地位和经济状况

正确答案：B。疾病性质和病人的人格特征